国家药品不良反应监测中心病例报告显示，莲必治注射液不良反应表现为急性肾功能损害、皮疹、头晕、胃肠道反应、过敏样反应等，并在药品不良反应信息通报中进行了相关报告。关于莲必治注射液相关用药指导的说法，错误的是
A. 有肾脏疾患的患者应避免使用该药
B. 老年人、儿童、哺乳期妇女禁用
C. 应避免与氨基糖苷类等有肾毒性药物联合使用
D. 严格掌握适应证，加强对用药患者肾功能的监测
E. 如患者用药后出现腰痛、腰酸等，应立即到医院就诊，检查肾功能情况

正确答案：B。老年人、儿童、哺乳期妇女禁用

解析：本题考查的是莲必治注射液的用药指导。对于老年人、儿童、孕妇、哺乳期妇女以及有肾脏疾患的患者应避免使用莲必治注射液（B错，为本题正确答案）。莲必治注射液的用药指导：①临床医生严格掌握适应证，加强对用药患者肾功能的监测（D对）。②避免与氨基糖苷类等有肾毒性药物联合使用（C对）。③对于老年人、儿童、孕妇、哺乳期妇女以及有肾脏疾患的患者应避免使用（A对）。④患者用药后出现腰痛、腰酸等症状，应立即到医院就诊，检查肾功能情况（E对）。